流感病毒的分型根据是
A. 血凝素
B. 神经氨酸酶
C. RNA多聚酶抗原
D. NP和M蛋白的抗原
E. 所致疾病的临床特征

正确答案：D。NP和M蛋白的抗原

解析：流感病毒根据NP和M蛋白的抗原性不同，分为甲（A）、乙（B）、丙（C）三个血清型流感病毒。甲型又根据HA（分H1～H16）和NA（分N1～N9）的抗原性不同，再区分为若干亚型甲型流感病毒（HnNn），理论上至少有144种血清亚型。掌握“正、副黏病毒”知识点。